女性，52岁。右侧后牙冷水刷牙时酸痛明显2周。无自发痛。口腔检查：右上后牙未见明显龋病，叩诊（-），牙周检查（-）。右上45颊侧颈部有缺损，呈楔状，探诊酸痛。拟诊断
A. 牙隐裂
B. 楔状缺损
C. 中龋
D. 磨损
E. 牙周萎缩

正确答案：B。楔状缺损

解析：本题考查楔状缺损。女性，52岁。右侧后牙冷水刷牙时酸痛明显2周。无自发痛。口腔检查：右上后牙未见明显龋病，叩诊（-），牙周检查（-）。右上45颊侧颈部有缺损，呈楔状，探诊酸痛。拟诊断楔状缺损（B对）。楔状缺损为发生在牙齿唇、颊面颈部呈楔形的缺损，多发生于口角附近的牙齿，患牙一般没有牙周病；损害深度达到牙本质时，表现为冷热酸甜刺激不适或激发痛，探诊有酸痛感觉。牙隐裂的症状有激发痛、咬合痛、自发痛等（A错）。患者右上后牙未见明显龋病、牙周检查（-），可排除龋病和牙周萎缩（CE错）。磨损表现为牙齿尖、窝、沟、嵴结构模糊，颈部一般无异常表现（D错）。